我国现行《住宅设计规范》对起居室采光系数最低值和窗地面积比值（Ac/Ad）的要求分别是
A. 采光系统最低值为1%，窗地面积比值（Ac/Ad）为1/7
B. 采光系统最低值为0.5%，窗地面积比值（Ac/Ad）为1/7
C. 采光系统最低值为1%，窗地面积比值（Ac/Ad）为1/12
D. 采光系统最低值为0.5%，窗地面积比值（Ac/Ad）为1/12
E. 采光系统最低值为1.5%，窗地面积比值（Ac/Ad）为1/7

正确答案：A。采光系统最低值为1%，窗地面积比值（Ac/Ad）为1/7

解析：本题考查我国现行《住宅设计规范》对起居室采光系数最低值和窗地面积比值（Ac/Ad）的要求。采光系数是指室内工作水平面上（或距窗1米处）散射光的照度与室外相同时间空旷无遮光物的地方接受整个天空散射光（全阴天，见不到太阳，但不是雾天）的水平面上照度的百分比（%）。窗地面积比值（Ac/Ad）指天然采光口的窗玻璃面积与室内地面面积之比。我国现行《住宅设计规范》对起居室采光系数最低值和窗地面积比值（Ac/Ad）的要求分别是：采光系统最低值不应低于1%，窗地面积比值（Ac/Ad）不应小于1/7（A对BCDE错）。